《中国药典》规定，中药的浸出物测定法有
A. 水溶性浸出物测定法
B. 醇溶性浸出物测定法
C. 三氯甲烷浸出物测定法
D. 二甲苯浸出物测定法
E. 挥发性醚浸出物测定法

正确答案：A、B、E。水溶性浸出物测定法；醇溶性浸出物测定法；挥发性醚浸出物测定法

解析：本题考查的是浸出物测定法。《中国药典》规定，中药的浸出物测定法有水溶性浸出物测定法（A对）、醇溶性浸出物测定法（B对）与挥发性醚浸出物测定法（E对）。浸出物测定：对某些暂时无法建立含量测定项的中药，或已有含量测定项的中药，为了更全面地控制中药的质量，一般可根据该中药已知化学成分的类别，结合用药习惯、中药质地、药效研究结果等，选用适宜的溶剂为溶媒，测定中药中可溶性物质的含量，以示中药的品质。通常选用水、一定浓度的乙醇（或甲醇）、水饱和正丁醇、乙醚作溶剂，用冷浸法或热浸法做中药的浸出物测定。测定用的供试品需粉碎，使能通过二号筛，并混合均匀，按《中国药典》规定的方法进行测定。《中国药典》规定，浸出物测定法有3种：①水溶性浸出物测定法，分为冷浸法和热浸法；②醇溶性浸出物测定法，亦分为冷浸法和热浸法；③挥发性醚溶性浸出物测定法。